对十二指肠悬肌(Treiz韧带）的描述，何者错误？
A. 由横纹肌、平滑肌和结缔组织构成
B. 上端起自膈的右脚
C. 下端附于十二指肠空肠曲
D. 是区分十二指肠水平部与升部的标志
E. 对十二指肠空肠曲有悬吊、固定的作用

正确答案：D。是区分十二指肠水平部与升部的标志

解析：十二指肠悬肌由横纹肌、平滑肌的肌纤维和结缔组织构成(A对)，上端起自右膈脚(B对)，下端连于十二指肠空肠曲(C对)，是空肠起始的标志(D错，为本题正确答案)，有固定和悬吊十二指肠空肠曲的作用(E对)。